医源性传播是指
A. 指在疾病的防治过程中，诊疗区域和药品被污染所造成的的疾病的传播
B. 医务人员对患者进行操作不规范，使用器械方法不当引起的不良反应
C. 医护人员之间通过接触引起的疾病的传播
D. 患者之间由于相互接触引起的传播
E. 医务人员使用不合格药物，或过期变质药物引起的不良反应

正确答案：A。指在疾病的防治过程中，诊疗区域和药品被污染所造成的的疾病的传播

解析：医源性传播是指在医疗、预防工作中，由于未能严格执行规章制度和操作规程，而人为的造成某些传染病的传播。一般有两种类型，一类是在进行医疗预防措施时，未严格执行必要的规章制度，由所用器械、针筒、针头、针刺针、采血器、导尿管等被污染，传播某些传染病，即在疾病的防治过程中，诊疗区域和药品被污染所造成的的疾病的传播（A对B错），如乙肝；另一类是由于药品或生物制品受污染而引起的传播，或器官移植引起的传播，这类情况较少见。